下列有关药物流行病学的描述。正确的有
A. 可科学地发现用药人群中的药品不良反应
B. 有助于调整剂量实现个体化给药
C. 是运用流行病学原理和方法研究人群中药物的利用及其效应的学科
D. 可建立用药人群数据库，提高药物警戒工作质量
E. 为临床药理学的新分支学科

正确答案：A、C、D。可科学地发现用药人群中的药品不良反应；是运用流行病学原理和方法研究人群中药物的利用及其效应的学科；可建立用药人群数据库，提高药物警戒工作质量

解析：本题考查药物流行病学。药物流行病学是运用流行病学的原理和方法，研究人群中药物的利用及其效应的应用科学（C对）。药物流行病学的主要内容如下：（1）流行病学方法科学地发现用药人群中的药品不良反应（A对），保证用药安全。（2）通过研究为药品临床评价提供科学的依据，促进合理用药。（3）建立用药人群的数据库，使药品上市后的管理监测规范和实用，提高药物警戒（PV）工作的质量，有助于减少药物不良事件（ADE）（D对）。（4）通过对ADR因果关系的了解和判断，有助于改进医师的处方决策，提高处方质量。调整剂量实现个体化给药属于个体化给药范畴（B错），不属于药物流行病学范畴。药物流行病学是临床药学与流行病学两个学科相互渗透、延伸而发展起来的新的医学研究领域，并不是单独的临床药理学的新分支学科（E错）。